去净龋坏组织的临床标准是
A. 窝洞的形状
B. 洞壁的颜色
C. 组织的硬度
D. 洞底的颜色
E. 器械的硬度

正确答案：C。组织的硬度

解析：本题考查去除龋损组织。去净龋坏组织的临床标准是组织的硬度（C对）。临床上一般根据牙本质的硬度和着色两个标准来判断龋坏组织是否去净；慢性龋进展缓慢，修复反应强，早期病变组织可重新矿化，此种再矿化牙本质颜色较正常牙本质深，但质硬，应予以保留，故洞壁的颜色和洞底的颜色不能作为去净龋坏组织的主要标准（BD错）；判断龋坏组织是否去净最重要的标准是牙体组织的硬度（C对）。窝洞的形状应根龋坏的范围而决定，与龋坏组织是否去净无关（A错）。器械的硬度与是否去净龋坏组织无关（E错）。